血白细胞总数增多，可见于
A. 伤寒杆菌感染
B. 再生障碍性贫血
C. 急性失血
D. 使用氯霉素的影响
E. 脾功能亢进

正确答案：C。急性失血

解析：血白细胞总数增多，可见于急性失血（C对），急性失血时，外周血中的血红蛋白含量及红细胞数尚未下降，由于身体处于应急状态，白细胞总数却明显增多，可高达20×109/L。伤寒杆菌感染（A错）、再生障碍性贫血（B错）、使用氯霉素的影响（D错）、脾功能亢进（E错）均使中性粒细胞数减少，故血白细胞总数减少。